不是家庭常用的化学消毒剂
A. 次氯酸钙
B. 二氧化氯
C. 环氧乙烷
D. 苯扎溴铵、乙醇和碘酒
E. 过氧乙酸

正确答案：B。二氧化氯

解析：本题考查家庭常用的化学消毒剂。化学消毒剂是指用于杀灭病原微生物的化学药物。家庭常用的化学消毒剂主要有次氯酸钙（A对）、环氧乙烷（C对）、过氧乙酸（E对）、苯扎溴铵、乙醇和碘酒（D对）等。二氧化氯（B错，为本题正确答案）不是家庭常用的化学消毒剂。